男性输尿管盆段下端前方有
A. 精囊腺
B. 输精管
C. 前列腺
D. 尿道球
E. 膀胱尖

正确答案：B。输精管

解析：输精管（B对）在输尿管盆段下端前方经过，至膀胱底的后面和直肠前面。